社会因素影响健康的规律与特点下列正确的是
A. 恒常性与积累性
B. 泛影响性和变异性
C. 交互作用与特异性
D. 恒常性与易变性
E. 积累性与跳跃性

正确答案：A。恒常性与积累性